属五行相乘传变的是
A. 肝病及心
B. 肝病及肾
C. 肝病及肺
D. 肝病及脾
E. 脾病及心

正确答案：D。肝病及脾

解析：母病及子指病变从母脏传来，并依据相生方向侵及属子的脏腑。肝属木，心属火，木生火，肝为心之母脏，肝病及心属母病及子（A错）。子病及母是指病变从子脏传来，侵及属母的脏腑。肝属木，肾属水，水生木，肝为肾之子脏，肝病及肾属子病及母（B错）。相侮传变即反克为害。肝属木，肺属金，金克木，但出现木火刑金，肝病及肺，属相侮传变（C错）。相乘传变即相克太过导致的疾病传变。肝属木，脾属土，木克土，木亢乘土，肝病及脾，属五行相乘（D对）。子病及母是指病变从子脏传来，侵及属母的脏腑。脾属土，心属火，火生土，脾为心之子脏，脾病及心，属子病及母（E错）。